屈远侧指骨间关节
A. 蚓状肌
B. 骨间掌侧肌
C. 骨间背侧肌
D. 指浅屈肌
E. 指深屈肌

正确答案：E。指深屈肌

解析：蚓状肌（A错）屈第2～5指掌指关节和伸其指骨间关节。骨间掌侧肌（B错）内收第2、4、5指，屈第2、4、5指掌指关节和伸其指骨间关节。骨间背侧肌（C错）固定第3指，外展第2、4指，屈第2～4指掌指关节和伸其指骨间关节。指浅屈肌（D错）屈2～5指近侧指骨间关节和掌指关节，屈腕和屈肘。指深屈肌（E对）屈第2～5指指骨间关节和掌指关节，屈腕。